输尿管的行程哪项有错
A. 起于肾盂
B. 经腰大肌前面下降
C. 子宫动脉横过输尿管前上方
D. 开口于膀胱体前方
E. 左侧跨过髂总动脉，右侧跨过髂外动脉

正确答案：D。开口于膀胱体前方

解析：输尿管起自肾盂下端（A对），腹部经腰大肌前面下行（B对），左侧输尿管越过左髂总动脉末端前方；右侧输尿管则越过右髂外动脉起始部的前方（C对）。女性输尿管从子宫动脉后下方绕过（D对），开口于膀胱底（E错,为本题正确答案）。